外科的善恶顺逆指的是
A. 病情轻重程度
B. 正邪力对比
C. 疮疡局部发展好坏
D. 全身脏腑功能盛衰
E. 综合局部、全身情况判断预后

正确答案：E。综合局部、全身情况判断预后

解析：善证与恶证多指全身表现：顺证与逆证多指局部表现。善证与恶证、顺证与逆证之间可以相互转化，要密切观察病情变化，及时调整治疗和护理措施，尽可能转恶为善，转逆为顺。综上所述，外科的善恶顺逆指的是综合局部、全身情况判断预后（E对）。